忌用麻仁润肠丸的病症有
A. 肠梗阻之便秘
B. 结肠癌之便秘
C. 炎症性肠病之便秘
D. 胃肠积热之便秘
E. 严重肠道憩室之便秘

正确答案：A、B、C、E。肠梗阻之便秘；结肠癌之便秘；炎症性肠病之便秘；严重肠道憩室之便秘

解析：本题考查的是麻仁润肠丸注意事项。忌用麻仁润肠丸的病症有肠梗阻之便秘（A对）、结肠癌之便秘（B对）、炎症性肠病之便秘（C对）、严重肠道憩室之便秘（E对）。麻仁润肠丸注意事项：孕妇忌服，结肠癌、严重的肠道憩室、肠梗阻及炎症性肠病等严重器质性病变引起的排便困难者忌用，虚寒性便秘不宜服用，年青体壮者便秘时不宜用，妇女月经期、儿童及年老体弱者慎用。